有机磷农药中毒常用的解毒剂有哪二种
A. 胆碱酯酶复能剂、氯磷定
B. 胆碱酯酶复能剂、解磷定
C. 胆碱酯酶复能剂、阿托品
D. 胆碱酯酶复能剂、美蓝
E. 氯磷定、解磷定

正确答案：C。胆碱酯酶复能剂、阿托品

解析：本题考查有机磷农药中毒的治疗措施。当发生有机磷酸酯农药中毒时，应迅速给予解毒药物。轻度中毒者可单独给予阿托品；中度或重度中毒者，应将阿托品及胆碱酯酶复能剂（C对ABDE错）两者并用。当两者合并使用时，有协同作用，剂量应适当减少。注意阿托品化（瞳孔扩大、颜面潮红、皮肤无汗、口干、心率加速），防止阿托品过量、中毒。